在为集体儿童制定合理的生活制度时，下列哪一项考虑是错误的
A. 儿童的神经发育特点
B. 儿童的年龄
C. 季节气候因素
D. 托幼园所的时间安排
E. 人体的生物钟节律

正确答案：D。托幼园所的时间安排